下列哪种情况不予进行换药
A. 更换或去除引流物时
B. 创口渗血较多或有大量分泌液溢出时
C. 外科创口已经愈合时
D. 感染、敷料松脱或过紧时
E. 伤口剧痛以及需要观察创口或皮瓣时

正确答案：C。外科创口已经愈合时

解析：临床上一般在更换或去除引流物、创口渗血较多或有大量分泌液溢出、疑有血肿形成或感染、敷料松脱或过紧、伤口剧痛以及需要观察创口或皮瓣等情况时才进行换药。掌握“口外创口处理”知识点。